男，65岁，高血压病史18年，近日有时夜间出现胸闷，并有频发的阵发性室上性心动过速，此时宜选用
A. 硝苯地平
B. 普萘洛尔
C. 心律平
D. 维拉帕米
E. 卡托普利

正确答案：D。维拉帕米

解析：维拉帕米治疗室上性和房室结折返引起的心律失常效果好，对急性心肌梗死、心肌缺血及洋地黄中毒引起的室性早搏有效。为阵发性室上性心动过速首选药。掌握“抗高血压药”知识点。